关于筛检，正确的说法是
A. 从有病的人群中确诊病人
B. 是一种诊断方法
C. 从无病的人群中找出病人
D. 从表面上无病的人群中查出某病的可疑患者
E. 筛检阳性的人不需再确诊

正确答案：D。从表面上无病的人群中查出某病的可疑患者